中医学认为妊娠剧吐得主要发病机理是
A. 脾胃虚弱，肝气偏旺
B. 冲气上逆，胃失和降
C. 肝失条达，气机郁滞
D. 痰湿内停，阻遇脾阳
E. 肝气郁结，胃气上逆

正确答案：B。冲气上逆，胃失和降

解析：孕后血聚养胎，冲气偏盛而上逆，循经犯胃引起恶心呕吐，其主要发病机理是冲气上逆，胃失和降（B对）。妊娠呕吐病因有脾胃虚弱（A错）、肝热犯胃（C错）、肝气郁结（E错）、痰饮内停（D错）。